下列各项，叩诊不会出现浊音的是
A. 肺不张
B. 肺空洞
C. 胸腔积液
D. 胸膜肥厚粘连
E. 胸壁水肿

正确答案：B。肺空洞

解析：鼓音如同击鼓声，是一种和谐的乐音，音响比清音更强，振动持续时间也较长，在叩击含有大量气体的空腔脏器时出现，正常情况下可见于胃泡区和腹部，病理情况下可见于肺内空洞（B错，为本题正确答案）、气胸、气腹等。浊音是一种音调较高，音响较弱，振动持续时间较短的非乐性叩诊音，除音响外，板指所感到的振动也较弱，当叩击被少量含气组织覆盖的实质脏器时产生，如叩击心或肝被肺段边缘所覆盖的部分，或在病理状态下如肺炎（肺组织含气量减少）、肺不张（A对）、胸腔积液（C对）、胸膜肥厚粘链（D对）、胸壁水肿（E对）等的叩诊音。